长期大量应用双嘧达莫治疗缺血性心脏病时，可能导致患者缺血加重，甚至病情恶化，可能的原因是
A. 冠状动脉窃血
B. 双嘧达莫抵抗
C. 抗血小板药物继发失效
D. 治疗反应变异
E. 血小板高反应性

正确答案：A。冠状动脉窃血

解析：本题考查双嘧达莫导致患者缺血加重、病情恶化的原因。长期大量应用双嘧达莫治疗缺血性心脏病时，可能导致患者缺血加重，甚至病情恶化，可能的原因是冠状动脉窃血（A对）。双嘧达莫为抗血小板聚集药，长期大量应用可致出血倾向，可能发生“冠状动脉窃血”，导致病情恶化。